氯化消毒剂对病毒的主要作用是
A. 对核酸的致死性损害
B. 使蛋白质变性
C. 抑制其对氧的利用
D. 氧化破坏多种酶系统
E. 吞噬作用

正确答案：A。对核酸的致死性损害

解析：本题考查氯化消毒剂对病毒的主要作用。氯对病毒的作用，在于对核酸的致死性损害（A对CDE错）。病毒缺乏一系列代谢酶，对氯的抵抗力较细菌强，氯较易破坏-SH键，而较难使蛋白质变性（B错）。